属于抗逆转录病毒的药物是
A. 恩替卡韦
B. 伐昔洛韦
C. 索磷布韦
D. 利托那韦
E. 奥司他韦

正确答案：D。利托那韦

解析：本题考查抗逆转录病毒药。抗逆转录病毒药分为四类：核苷类逆转录酶抑制药、非核苷类逆转录酶抑制药、蛋白酶抑制药、整合酶抑制剂。利托那韦（D对）为蛋白酶抑制药。